燥湿化痰的药物是
A. 陈皮
B. 青皮
C. 香附
D. 沉香
E. 大腹皮

正确答案：A。陈皮

解析：以上选项均为理气药。陈皮辛香走窜，温通苦燥，入脾胃经，有行气、除胀、燥湿之功，故为治脾胃气滞、湿阻之院腹胀满、食少吐泻之佳品，对寒湿阻滞中焦者，最为适宜；苦降之性，为治呕吐、呃逆之佳品；苦温，长于燥湿化痰（A对），又能理气宽胸，为治湿痰、寒痰之要药；辛行温通，入肺走胸，能行气通痹止痛。余选项无燥湿化痰之功。